手指甲两侧的化脓性感染属于
A. 手癣
B. 手疮
C. 蛇眼疔
D. 烂疔
E. 红丝疔

正确答案：C。蛇眼疔

解析：甲沟炎是甲沟及其周围组织的化脓性感染，中医学称为“蛇眼疔”（C对）。手癣（A错）为手掌的皮肤真菌感染。手疮（B错）是手部疮疡的统称。烂疔（D错）是一种发于皮肉之间，易于腐烂，病势凶险的急性传染性疾病，相当于西医的气性坏疽。红丝疔（E错）多发于四肢，因有细红丝一条，迅速向上走窜，故名红丝疔，相当于西医的急性淋巴管炎。